下列各项，不属卫生行政处罚的是
A. 警告
B. 停止损害
C. 罚款
D. 没收违法所得
E. 责令停产停业

正确答案：B。停止损害

解析：卫生行政处罚程序所指行政处罚，是指县级以上卫生行政机关依据卫生法律、法规、规章，对应受制裁的违法行为，做出的警告（A对）、罚款（C对）、没收违法所得（D对）、责令停产停业（E对）、吊销许可证以及卫生法律、行政法规规定的其他行政处罚。停止损害不属于卫生行政处罚范围（B错，为本题正确答案）。